下列腧穴不属于十二经脉的是
A. 关冲
B. 天枢
C. 大赫
D. 少冲
E. 安眠

正确答案：E。安眠

解析：奇穴指不归属于十四经，但具有一定名称、固定位置和一定主治作用的腧穴，安眠属奇穴，不属十二经脉（E对）。关冲属手少阳三焦经（A错）。天枢属足阳明胃经（B错）。大赫属足少阴肾经（C错）。少冲属手少阴心经（D错）。